特纳牙是由于
A. 服用四环素所致
B. 饮水氟含量过多所致
C. 患儿严重的发热性疾病所致
D. 先天发育缺陷
E. 乳牙根尖周严重感染所致

正确答案：E。乳牙根尖周严重感染所致

解析：本题考查特纳牙。特纳牙是由于乳牙的根尖周严重感染（E对），导致继承恒牙釉质发育不全而引起的，为后天因素所致（D错）。服用四环素可导致四环素牙（A错）。饮水氟含量过多可致氟牙症（B错）。患儿严重的发热性疾病可导致全口牙釉质发育不全（C错）。